下列关于颊神经的描述中哪项是错误的
A. 是下颌神经的分支
B. 分布于颊粘膜及皮肤
C. 分布于下颌前磨牙和磨牙颊侧牙龈
D. 分布于颊肌
E. 属于感觉神经

正确答案：D。分布于颊肌

解析：本题考查三叉神经的分支与分布。颊神经是下颌神经（A对）前干的一个分支，是前干中唯一的感觉神经。颊神经（颊长神经）：自翼外肌上下头之间穿出，在喙突内侧缘沿下颌支前缘行向前下，在颞肌和咬肌前缘的覆盖下，穿过颊脂垫，分布于下颌第二前磨牙与磨牙颊侧牙龈（C对）及颊部粘膜与皮肤（B对D错，D为本题正确答案）。颊神经为感觉神经（E对），内无运动纤维。颊肌的运动由面神经支配。